白血病的牙龈病损的主要病理表现是
A. 牙龈中充满大量幼稚白细胞
B. 牙龈中有大量毛细血管增生
C. 牙龈中有大量胶原纤维增生
D. 牙龈上皮增生
E. 以上都是

正确答案：A。牙龈中充满大量幼稚白细胞

解析：本题考查白血病的牙龈病损的病理表现。白血病的牙龈病损，其病理变化为牙龈上皮和结缔组织内充满密集的幼稚白细胞（A对）致使牙龈肿大，而并非牙龈上皮内结缔组织本身的增生或牙龈上皮增生（D错）。结缔组织高度水肿变性，胶原纤维被幼稚血细胞替代，牙龈中没有大量胶原纤维增生（C错）。白血病患者牙龈中没有大量毛细血管增生（B错），相反毛细血管扩张腔内可见血细胞形成栓塞，并可见组织坏死。